下列表达于B细胞、巨噬细胞、树突细胞是APC表面的
A. HLA-Ⅰ类分子
B. HLA-Ⅱ类分子
C. HLA-Ⅲ类分子
D. HLA-Ⅳ类分子
E. HLA-Ⅴ类分子

正确答案：B。HLA-Ⅱ类分子

解析：HLA-Ⅱ类分子表达于B细胞、巨噬细胞、树突细胞等APC的表面。掌握“HLA种类及其产物、医学意义”知识点。